非处方药遴选原则的“应用安全”是指
A. 剂量易于掌握
B. 包装严密
C. 使用时无需医师辨证
D. 不含有毒药物
E. 经常使用不会引起耐药性

正确答案：C。使用时无需医师辨证